下列属于稳定型（劳力性）心绞痛症状的是
A. 开始运动时心前区疼痛，行走5分钟后缓解
B. 搬重物感心前区针刺样疼痛，伴呼吸困难
C. 骑自行车上坡时感心前区疼痛，休息5分钟自行缓解
D. 夜间呼吸困难，坐位缓解
E. 步行五分钟心前区疼痛，伴呼吸困难

正确答案：C。骑自行车上坡时感心前区疼痛，休息5分钟自行缓解

解析：稳定型（劳力性）心绞痛的发作常由体力劳动或清绪激动（如愤怒、焦急、过度兴奋等）诱发，也可以由饱食、寒冷、吸烟、心动过速、 休克等诱发。典型症状为在劳力或情绪激动的当时，胸骨体之后的部位出现压迫、发闷或紧缩性，也可有烧灼感，但不像针刺或刀扎样锐性痛，偶伴濒死感的疼痛，可持续数分钟至十余分钟，多为 3~5 分钟，一般不超过半小时。疼痛范围可波及心前区，手掌大小范围，也可横贯前胸，界限不清。常放射至左肩、左臂内达无名指和小指，或至颈、咽或下颌部。病人常需要停止原来诱发症状的活动后即可缓解，也可舌下含用硝酸甘油等硝酸脂类药物缓解，时间为3~5分钟（C对ABDE错）。